下列哪种情况下，应给小儿及时断奶
A. 年龄已过1岁
B. 母乳不足
C. 母乳亢足
D. 小儿患热病
E. 母亲患热病

正确答案：E。母亲患热病

解析：母亲患热病，可能传染给小儿，不宜哺乳（E对）。断奶时间视母婴情况而定。一般可在小儿10-12个月时断奶，若母乳量多者，年龄已过1岁也可适当延期（A错）。母乳不足可采取混合喂养（B错）。母乳亢足可先用吸奶器取出放置（C错）。小儿患热病可能影响其胃口，但不宜断奶（D错）。